治疗金黄色葡萄球菌引起的骨髓炎的首选药是
A. 青霉素
B. 红霉素
C. 庆大霉素
D. 林可霉素
E. 卡那霉素

正确答案：D。林可霉素